治疗“惊风”提出用“急惊用凉泻，慢惊用温补”的医家是
A. 扁鹊
B. 董汲
C. 钱乙
D. 陈文中
E. 万全

正确答案：C。钱乙

解析：钱乙的《小儿药证直诀》指出急惊风的病位在心肝，慢惊风的病位在脾胃，提出“急惊用凉泻，慢惊用温补”的治疗原则（C对）。扁鹊（A错）是我国历史上最早记载的儿科医生，《史记·扁鹊仓公列传》：“扁鹊…人咸阳，闻秦人爱小儿，即为小儿医”。董汲（B错）擅用寒凉法治疗，总结撰成《小儿斑疹备急方论》，是为天花、麻疹类专著之始。陈文中（D错）著《小儿痘疹方沦》和《小儿病源方论》，主张固养小儿元阳，以擅用温补扶正见长。万全（E错）著《幼科发挥》、《育婴秘诀》，系统提出了“阳常有余、阴常不足”，“肝常有余、脾常不足”，“心常有余、肺常不足”，“肾常虚”等观点，十分重视小儿护养，提出了“预养以培其元，胎养以保其真、蓐养以防其变、鞠养以慎其疾”的育婴四法。